关于肾脏对葡萄糖重吸收的描述，错误的是
A. 重吸收部位仅限近端小管
B. 经过通道的易化扩散进行
C. 需要转运蛋白
D. 葡萄糖的重吸收与Na⁺的转运密切相关
E. 肾糖阈正常值为10mmol/L

正确答案：B。经过通道的易化扩散进行

解析：肾脏对葡萄糖重吸收是通过近端小管上皮细胞顶端膜中的Na⁺-葡萄糖同向转运体（CD对），以继发性主动转运的方式进行（B错，为本题正确答案）。滤过的葡萄糖均在近端小管（A对），特别是近端小管的前半段被重吸收。当血糖浓度达180mg/100ml（10mmol/L）（E对）血液时，尿中开始出现葡萄糖，此时的血浆葡萄糖浓度称为肾糖阈。